当上下颌双侧后牙缺失时，下列哪项可作为排后牙的标准
A. 上、下第一前磨牙的位置关系
B. 上、下第二磨牙的位置关系
C. 上、下第二前磨牙的位置关系
D. 上、下第一磨牙的位置关系
E. 上、下尖牙的位置关系

正确答案：D。上、下第一磨牙的位置关系

解析：上下颌双侧后牙缺失，应按全口义齿排牙原则进行排牙，上、下第一磨牙的位置关系，可作为排后牙的标准。掌握“局部义齿颌位关系记录及人工牙选择”知识点。